加兰他敏可用于治疗
A. 失眠
B. 抑郁症
C. 帕金森病
D. 阿尔茨海默病
E. 精神分裂症

正确答案：D。阿尔茨海默病

解析：本题考查加兰他敏的适应证。加兰他敏属于胆碱酯酶抑制药，对轻、中度阿尔茨海默病（AD）（D对）患者有效。失眠（A错）可用镇静催眠药如苯二氮卓类。抑郁症（B错）可用抗抑郁药如单胺氧化酶抑制剂。帕金森病（C错）可用抗帕金森病药如金刚烷胺、吡贝地尔、恩他卡朋等。精神分裂症（E错）可用抗精神分裂药如氯丙嗪。